细菌由根方侵入后，牙髓炎症由根髓开始，临床上又称为
A. 急性牙髓炎
B. 慢性牙髓炎
C. 根尖周炎
D. 逆行性牙髓炎
E. 牙本质敏感

正确答案：D。逆行性牙髓炎

解析：细菌由根方侵入后，牙髓炎症由根髓开始，临床上又称为逆行性牙髓炎。掌握“残髓炎及逆行性牙髓炎”知识点。